社区口腔疾病预防和治疗适宜技术主要包括
A. 局部用氟
B. 窝沟封闭
C. 预防性树脂充填
D. 非创伤性修复治疗
E. 以上均包括

正确答案：E。以上均包括

解析：社区口腔疾病预防和治疗适宜技术主要包括局部使用氟化物、窝沟封闭、预防性树脂充填、非创伤性修复治疗、洁牙等。掌握“社区口腔卫生服务”知识点。